下列对蛋白质变性的描述中，正确的是
A. 变性蛋白质的溶液粘度下降
B. 变性的蛋白质不易被消化
C. 蛋白质沉淀不一定就是变性
D. 蛋白质变性后容易形成结晶
E. 蛋白质变性不涉及二硫键破坏

正确答案：C。蛋白质沉淀不一定就是变性

解析：蛋白质的变性主要发生二硫键和非共价键的破坏，不涉及一级结构中氨基酸序列的改变（E错）。蛋白质变性后，其理化性质及生物学性质发生改变，如溶解度降低、粘度增加（A错）、结晶能力消失（D错）、生物学活性丧失、易被蛋白酶消化水解（B错）等。变性的蛋白质易于沉淀，有时蛋白质发生沉淀，但并不变性（C对）。